与反气旋有关的下列描述中不正确的是
A. 气流顺时针方向旋转
B. 风速大
C. 阻止污染物向上扩散
D. 天气晴朗
E. 出现逆温

正确答案：B。风速大

解析：本题考查反气旋的相关内容。当地面受高压控制时，中心部位的空气向周围下降，呈顺时针方向旋转（A对），形成反气旋。此时天气晴朗（D对），风速小（B错，为本题正确答案），出现逆温层（E对），阻止污染物向上扩散（C对）。